了解胎儿成熟度最常用的检查项目是
A. 检测羊水中卵磷脂/鞘磷脂比值
B. 检测羊水中肌酐值
C. 检测羊水中胆红素类物质
D. 检测羊水中淀粉酶值
E. B型超声检查胎儿双顶径值

正确答案：E。B型超声检查胎儿双顶径值

解析：B超测定胎儿双顶径（BPD）为临床上了解胎儿成熟度最常用的检查方法（E对）。BPD﹥8.5cm提示胎儿成熟。检测羊水卵磷脂/鞘磷脂比值（P153）（A错）可了解胎儿肺是否成熟。检测羊水肌酐值（B错）可了解胎儿肾是否成熟。检测羊水中胆红素类物质可了解胎儿肝脏是否成熟（C错）。检测羊水中淀粉酶值（D错）可了解胎儿唾液腺是否成熟。ABCD检查项目都需要行羊膜腔穿刺抽取羊水，属于有创检查，临床上少用。